鼻腭神经阻滞麻醉将麻药注入腭前孔，此处的腭前孔就是
A. 腭大孔
B. 切牙孔
C. 圆孔
D. 下颌孔
E. 颏孔

正确答案：B。切牙孔

解析：鼻腭神经阻滞麻醉将麻药注入腭前孔（切牙孔），以麻醉鼻腭神经，故又称为腭前孔注射法。掌握“颌面部常用局麻法及牙拔除的麻醉选择”知识点。